检验科医师贾某为交流业务信息，在朋友圈上传了一名艾滋病患者的检验数据，并进行了解读，其中包括患者的工作单位、有人提醒他此行为侵犯了患者的法定权利。贾某侵犯的患者权利是
A. 健康权
B. 姓名权
C. 身份权
D. 知情权
E. 隐私权

正确答案：E。隐私权

解析：本题中贾某在朋友圈中公开一名艾滋病患者的检验数据并进行解读，并包括了患者的工作单位，属于擅自公开艾滋病患者的病情及隐私内容，贾某侵犯的患者权利是隐私权（E对），此题并未涉及违反需要患者行使知情权（D错）的行为，亦未涉及医疗不良事件侵犯患者健康权（A错）的情况，而姓名权（B错）及身份权（C错）应属于隐私权的内容。